以下哪项不是窝洞制备的基本原则
A. 尽量保留健康牙体组织
B. 去净龋坏组织
C. 注意患者全身状况
D. 尽量保护悬基釉
E. 保护牙髓组织

正确答案：D。尽量保护悬基釉

解析：本题考查银汞充填术窝洞制备、干燥及充填。尽量保护悬基釉（D错，为本题正确答案）不是窝洞制备的基本原则。窝洞制备的基本原则包括：去净龋坏组织（B对）、保护牙髓组织（E对）、尽量保留健康牙体组织（A对）、注意患者全身状况（C对）。